正常人的腋窝温、口腔温和直肠温按温度由高至低排列顺序为
A. 口腔温，腋窝温，直肠温
B. 腋窝温，口腔温，直肠温
C. 口腔温，直肠温，腋窝温
D. 直肠温，腋窝温，口腔温
E. 直肠温，口腔温，腋窝温

正确答案：E。直肠温，口腔温，腋窝温